换药时持镊应在
A. 上1/3处
B. 中1/3处
C. 下1/3处
D. 上2/3处
E. 下2/3处

正确答案：A。上1/3处

解析：换药时持镊应在上1/3处，并勿使镊碰及非换药区，应掌握并使用双手持镊，保持一“脏”一“净”，即一镊接触创面，一镊接触药碗和消毒敷料。掌握“口外创口处理”知识点。